关于蜕膜，哪项描述是错误的
A. 受精卵着床后，子宫内膜转变为蜕膜
B. 底蜕膜发育成为胎盘的母体部分
C. 包蜕膜覆盖在胚泡表面
D. 真蜕膜覆盖子宫腔其他部分的蜕膜
E. 包蜕膜妊娠16～18周包蜕膜与真蜕膜逐渐融合

正确答案：E。包蜕膜妊娠16～18周包蜕膜与真蜕膜逐渐融合

解析：受精卵着床后，子宫内膜迅速发生蜕膜变。按蜕膜与胚泡的部位关系，将蜕膜分为三部分：①底蜕膜（与胚泡极滋养层接触的子宫肌层的蜕膜，以后发育成为胎盘的母体部分）；②包蜕膜（覆盖在胚泡表面，妊娠14～16周包蜕膜与真蜕膜逐渐融合，宫腔功能消失）；③真蜕膜（底蜕膜及包蜕膜以外覆盖子宫腔其他部分的蜕膜）。掌握“妊娠生理”知识点。